目部的心脏相关部位是
A. 眼胞
B. 瞳仁
C. 黑睛
D. 白睛
E. 内外眦的血络

正确答案：E。内外眦的血络

解析：古人将目的不同部位分属于五脏，如《灵枢·大惑论》曰：“精之窠为眼，骨之精为瞳子，筋之精为黑眼，血之精为络，其窠气之精为白眼，肌肉之精为约束”。后世医家据此而归纳为“五轮学说”。即瞳仁属肾，称为水轮（B错）；黑睛属肝，称为风轮（C错）；两眦血络属心，称为血轮（E错）；白睛属肺，称为气轮（D错）；眼睑属脾，称为肉轮（A错）。